中药熊胆解痉作用的主要成分是
A. 胆酸
B. 鹅去氧胆酸
C. 熊去氧胆酸
D. 去氧胆酸
E. 石胆酸

正确答案：C。熊去氧胆酸

解析：本题考查的是熊胆中的化学成分。中药熊胆解痉作用的主要成分是是熊去氧胆酸（C对）。熊胆的化学成分为胆汁酸类的碱金属盐及胆甾醇和胆红素。从生物活性方面讲，其主要有效成分为牛磺熊去氧胆酸，此外还有鹅去氧胆酸（B错）、胆酸（A错）和去氧胆酸（D错）。石胆酸（E错）为牛黄的化学成分。牛黄约含8%胆汁酸，主要成分为胆酸、去氧胆酸和石胆酸。此外，还含有7%SMC及胆红素，胆固醇，麦角固醇，多种氨基酸（如丙氨酸、甘氨酸、牛磺酸、精氨酸、天冬氨酸、蛋氨酸等）和无机盐等。《中国药典》以胆酸和胆红素为牛黄的质量控制成分，要求胆酸含量不少于4.0%，胆红素含量不得少于25.0%。